二期梅毒的表现为
A. 地图舌
B. 白斑
C. 毛状白斑
D. 黏膜斑
E. 树胶肿

正确答案：D。黏膜斑

解析：本题考查梅毒的临床表现。二期梅毒的表现为黏膜斑（D对）。黏膜斑：是二期梅毒的常见口腔表征。地图舌（A错）的典型表现为舌背、舌尖、舌缘等部位的典型地图样改变及其不断变化的游走特征。白斑（B错）是发生于口腔黏膜上以白色为主的损害不能擦去，也不能以临床和组织病理学的方法诊断为其他可定义的损害。好发部位包括牙龈、颊黏膜咬合线区域和舌部，唇、前庭沟、腭、口底也有发生。毛状白斑（C错）：被认为是患者全身免疫严重抑制的征象之一，主要见于HIV感染者。HIV感染即艾滋病。树胶肿（E错）是三期梅毒的损害。。